行为矫正的三大要素是
A. 内容、条件和过程
B. 对象、医生和居民
C. 目标、措施和手段
D. 情景、对象和医生
E. 对象、环境和过程

正确答案：E。对象、环境和过程